布鲁姆、拉隆达和德威尔等学者在20世纪70年代提出影响健康的因素是
A. 环境因素
B. 行为与生活方式
C. 生物、遗传因素
D. 医疗卫生服务因素
E. 以上均是

正确答案：E。以上均是